诊断小儿肾病综合征的必备条件是
A. 大量蛋白尿，高脂血症
B. 明显水肿，高脂血症
C. 大量蛋白尿，明显水肿
D. 低蛋白血症，明显水肿
E. 低蛋白血症，大量蛋白尿

正确答案：E。低蛋白血症，大量蛋白尿

解析：肾病综合症的特点为“三高一低”，即大量蛋白尿（＞3.5g/L，正常值＜0.1g/L）、低蛋白血症（＜30g/L，正常值35～50g/L）、高脂血症、明显水肿，其中，前两项为其诊断的必备条件（E对）。